因老人代谢改变，导致某些药物敏感性增强的是
A. 镇静药
B. β-受体阻断药
C. 抗凝药
D. 利尿药
E. 助消化药

正确答案：A、C、D。镇静药；抗凝药；利尿药

解析：本题考查老年人用药。因老人代谢改变，导致某些药物敏感性增强的是镇静药（A对）、抗凝药（C对）、利尿药（D对）等。老年人对β-受体阻断药（B错）的敏感性降低。对助消化药（E错）没有明显改变。